肠易激综合征患者典型的腹痛特点是
A. 具有季节性发作的特点
B. 没有规律
C. 便前疼痛，便后缓解
D. 疼痛，饭后缓解
E. 夜间疼痛

正确答案：C。便前疼痛，便后缓解

解析：肠易激综合征患者典型的腹痛特点是便前疼痛，便后缓解（C对）。腹痛具有季节性（A错）见于消化性溃疡（P359）。腹痛无规律（B错）可见于慢性胃炎。疼痛，饭后缓解（D错）与夜间疼痛（E错）见于十二指肠溃疡。几种内科疾病腹痛特点归纳如下：十二指肠球部溃疡表现为疼痛-进食-缓解；胃溃疡表现为进食-疼痛-缓解；溃疡性结肠炎表现为疼痛-便意-便后缓解；克罗恩病表现为进食-加重-便后缓解；结核性腹膜炎表现为持续性隐痛或钝痛；肠易激综合征表现为疼痛-排便-缓解。